男，65岁。急性前壁心肌梗死3小时。既往有高血压、糖尿病病史。平时血压140～150/70～80mmHg。查体：BP90/70mmHg，双肺呼吸音清，心率85次/分，律齐。该患者血压降低的最可能原因是
A. 主动脉壁硬化
B. 大动脉弹性降低
C. 心脏每搏输出量降低
D. 心率降低
E. 外周阻力降低

正确答案：C。心脏每搏输出量降低

解析：患者老年男性，急性前壁心肌梗死，平时血压140～150/70～80mmHg，入院查体：BP90/70mmHg（主要是收缩压降低），心率85次/分，律齐，最可能是心肌梗死导致心室收缩功能下降，顺应性减低、心肌收缩不协调，引起心脏每搏输出量降低（C对）。老年人由于主动脉壁硬化（A错），管壁弹性纤维减少而胶原纤维增多，导致血管可扩张性降低，大动脉弹性降低（B错），会出现收缩压增高而舒张压降低，脉压增大（九版生理学P121）。心肌梗死导致心脏每搏输出量降低，外周有效循环血量减少，血压下降，压力感受器传入冲动减少，压力感受性反射减弱，多引起心率加快（D错）。外周阻力（九版生理学P121）多影响舒张压，当外周阻力降低（E错）时，舒张压会比收缩压降低更明显，而本例舒张压无明显下降，主要为收缩压下降。